某男，20岁，农民，发热2周于7月20日入院，体温39.2℃，精神稍差，腹部5个小出血点，腹胀，脾侧位可及，血WBC4.1×10⁹/L，本病人最大可能的诊断是
A. 钩体病
B. 伤寒
C. 斑疹伤寒
D. 结核病
E. 流行性出血热

正确答案：B。伤寒